肠梗阻病人血清钾检测值为2.9mmol/L，临床上一般不表现为
A. 四肢无力
B. ST段降低
C. 皮肤苍白
D. 反常性酸性尿
E. 口苦

正确答案：C。皮肤苍白

解析：患者血清钾检测值为2.9mmol/L（正常的血钾浓度为3.5～5.5mmol/L），可诊断为低钾血症。而皮肤苍白（C错，为本题正确答案）为严重高血钾有微循环障碍时的表现（P14）。低血钾症最早的表现为四肢无力（A对），还可出现厌食、恶心、口苦（E对）等消化道症状。当心脏受累后可出现传导阻滞和节律异常，其典型的心电图表现为早期出现T波降低、变平或倒置，随后出现ST段降低（B对）、QT间期延长和U波。此外，由于机体的代偿作用，肾远曲肾小管Na⁺与K⁺之间的交换减少，而Na⁺与H⁺之间的交换增加，使机体通过尿液排H⁺增多，尿液呈酸性，即反常性酸性尿（D对）。